抽样调查的特点不包括
A. 不适于患病率低的疾病
B. 工作量相对较小，人力、物力投入相对较少
C. 设计、实施较复杂
D. 样本量小容易发现遗漏
E. 用样本统计量估计总体参数

正确答案：D。样本量小容易发现遗漏

解析：本题考查抽样调查的特点。抽样调查的特点是：1.工作量相对较小，人力、物力投入相对较少（B对）；2.设计、实施与资料分析较复杂（C对）；3.资料的重复或遗漏不易被发现（D错，为本题正确答案）；4.不适于变异过大的研究对象或因素和需要普查普治的疾病；5.不适于患病率低的疾病（A对）；6.能用样本统计量估计总体参数（E对）。